诊断慢性阻塞性肺疾病（COPD）的必要条件是
A. 胸部X线片示肺纹理增粗紊乱
B. 肺功能检查示阻塞性通气功能障碍
C. 高分辨CT示肺气肿改变
D. 长期大量吸烟史
E. 慢性咳嗽、咳痰病史

正确答案：B。肺功能检查示阻塞性通气功能障碍

解析：肺功能检查见持续性气流受限，吸入支气管扩张剂后FEV₁/FVC＜0.70，即出现持续性阻塞性通气功能障碍为诊断慢阻肺的必备条件（B对）。胸部X线片显示肺纹理增粗紊乱（A错）可见于慢性阻塞性肺病，也见于肺炎等疾病，特异性不高（P23），只对于鉴别本病有一定价值，因此不是诊断必备条件。高分辨率CT显示肺气肿改变（C错）对本病的诊断有提示作用，但其主要意义在于排除其他具有相似症状的呼吸系统疾病（P024），也不是COPD诊断的必备条件。长期大量吸烟史（D错）对COPD有一定提示价值，但是并不是所有患者都一定有长期吸烟史，因此其并不是诊断必备条件。慢性咳嗽、咳痰病史（E错）对COPD有一定提示价值，属于COPD的主要症状，但是也可见于多种呼吸系统疾病，因此并不是诊断的必备条件。